老年人的口腔保健认识中正确的是
A. 人老掉牙不是必然规律
B. 牙齿缺失多由龋病、牙周病等造成
C. 消除“人老掉牙”的观念
D. 良好的口腔习惯、保健方法可拥有健康的牙齿
E. 以上都正确

正确答案：E。以上都正确

解析：要不断提高老年人自身的口腔保健意识，帮助老年人树立正确的口腔健康观念，消除“人老掉牙”的旧观念。人老掉牙不是必然规律，大多是由于长期患有龋病、牙周病等口腔疾病造成的。只要预防和及时治疗口腔疾病，养成良好的口腔卫生习惯，掌握科学的口腔保健方法，就可终生拥有一副健康的牙齿。家庭、社会与专业人员应共同关注老年人的口腔健康，针对老年人的心理变化特点、口腔保健需求及普遍存在的口腔健康问题，有组织、有计划地利用各种大众宣传媒介，采取多种形式，在社区开展各种口腔健康宣传教育活动和口腔卫生指导。掌握“老年人口腔保健”知识点。